按照中医治疗学分类，中药功效可分为对因功效、对症功效、对病证功效和对现代病症功效等。下列不属于对病证功效的是
A. 截疟
B. 止咳平喘
C. 利胆退黄
D. 通鼻窍
E. 消痈排脓

正确答案：B。止咳平喘

解析：本题考查的是中药功效的分类。止咳平喘属于对症功效（B错，为本题正确答案）。中药功效按中医治疗学分类：①对因功效：是指某些中药能针对病因起治疗作用。具体包含祛邪、扶正、调理脏腑功效、消除病理产物等。其中，属于祛邪功效的有祛风、散寒、除湿、清热、泻下、涌吐、解毒、杀虫等；属于扶正功效的有补气、助阳、滋阴、养血等；属于调理脏腑或气血功效的有疏肝、柔肝、宣肺、和中、理气、活血、安神、开窍、潜阳、息风等；属于消除病理产物功效的有消食、利水、祛痰、化瘀、排石、排脓等。②对症功效：是指某些中药能缓解或消除疾病过程中出现的某些或某种症状，有助于减轻患者痛苦，防止病情恶化，如止痛、止血、止呕、止咳、平喘、止汗、涩肠止泻、涩精止遗等。③对病证功效：是指某些中药对疟疾、赘疣、痹证、鼻渊、黄疸、肺痈、绦虫证等病证，具有明显优于它药的疗效，如截疟（A对）、蚀疣、祛风湿、通鼻窍（D对）、利胆退黄（C对）、消痈排脓（E对）、驱杀绦虫等。④对现代病症功效：是指某些中药对现代医学所描述的高血压、高脂血症、糖尿病、肿瘤等病症有明显的疗效，而使用传统功效术语又难于表达清楚，故借现代药理学术语来表达，如夏枯草降血压，决明子降血脂，天花粉降血糖，半枝莲抗肿瘤等。